注射用美洛西林/舒巴坦，规格1.25g（美洛西林1.0g，舒巴坦0.25g）。成人静脉符合单室模型。美洛西林表观分布容积V=0.5L/Kg。注射用美洛西林钠/舒巴坦的质量要求不包括
A. 无异物
B. 无菌
C. 无热原、细菌内毒素
D. 粉末细度与结晶度适宜
E. 等渗或略偏高渗

正确答案：D。粉末细度与结晶度适宜

解析：本题主要考查注射剂的质量要求。粉末细度或结晶度需适宜（D错，为本题正确答案），便于分装是注射用无菌粉末的质量要求。注射剂的质量要求：1.pH 注射剂的pH应和血液pH相等或相近。一般控制在4～9的范围内。也可根据具体品种确定，同一品种的pH允许差异范围不超过±1.0。2.渗透压 对用量大、供静脉注射的注射剂应具有与血浆相同的或略偏高的渗透压（E对）。3.稳定性 注射剂要具有必要的物理稳定性和化学稳定性，以确保产品在贮存期内安全、有效。4.安全性 注射剂必须对机体无毒性、无刺激性，降压物质必须符合规定，确保安全。5.澄明 溶液型注射液应澄明，不得含有可见的异物（A对）或不溶性微粒。6.无菌（B对） 注射剂内不应含有任何活的微生物。7.无热原（C对） 注射剂内不应含热原，热原检查必须符合规定。